某女暑假经常是白天上网，晚上躺在床上看小说。等到开学，发现黑板上的字看不太清楚，便去校医室检查。检查右眼时，5.0和4.9行视标都看不清，4.8行认错2个，4.7行认错1个，4.6行全部认对。左眼检查结果相同。校医先让其看视力表，这是检查
A. 近视力
B. 远视力
C. 屈光
D. 散光
E. 眼压

正确答案：B。远视力